唾液腺结石病的X线检查，正确的是
A. 下颌下腺导管前段结石者，用下颌横断（牙合）片检查
B. 结石在导管后段或腺体内者，用下颌下腺侧位片检查
C. 腮腺导管前段结石用口内含片检查
D. 腮腺导管后段结石用鼓颊后前位片检查
E. 以上均正确

正确答案：E。以上均正确

解析：本题考查X线平片检查。唾液腺结石病的X线检查，正确的是下颌下腺导管前段结石者，用下颌横断牙合片检查（A对）；结石在导管后段或腺体内者，用下颌下腺侧位片检查（B对）；腮腺导管前段结石用口内含片检查（C对）；腮腺导管后段结石用鼓颊后前位片检查（D对）。综上，选E。唾液腺结石病以下颌下腺最多见，阳性结石用X线平片即可查出。怀疑下颌下腺导管前段结石者，用下颌横断牙合片检查；疑结石在导管后段或腺体内者，用下颌下腺侧位片检查。腮腺导管前段结石用口内含片检查，腮腺导管后段结石用鼓颊后前位片检查。锥形束CT和CT检查也可用于检查唾液腺结石。